治疗肝硬化肝肾阴虚证，应首选
A. 柴胡疏肝散
B. 调营饮
C. 附子理中汤合五苓散
D. 一贯煎合膈下逐瘀汤
E. 胃苓汤

正确答案：D。一贯煎合膈下逐瘀汤

解析：肝硬化肝肾阴虚证，治宜滋养肝肾，化气利水，首选滋阴疏肝的一贯煎合活血祛瘀，行气止痛的膈下逐瘀汤（D对）。柴胡疏肝散疏肝解郁，行气止痛，与胃苓汤合用可用于肝硬化气滞湿阻证（A错）。调营汤活血化瘀，化气行水，是治疗肝硬化肝脾血瘀证的代表方（B错）。附子理中汤合五苓散温肾补脾，化气利水，适用于肝硬化脾肾阳虚证（C错）。胃苓汤祛湿和胃，行气利水，主治夏秋之间，脾胃伤冷，水谷不分，泄泻如水者（E错）。